女，65岁，乏力、胸痛1个月，既往体健，查体：轻度贫血貌，双侧肋骨有局部压痛，实验室检查：血常规：Hb80g/L，WBC5.6×10⁹/L，Plt120×10⁹/L，血清总蛋白100g/L，白蛋白27g/L，SCr190μmol/L，骨髓细胞学检查是骨髓中幼浆细胞占0.45。为明确诊断，最重要的检查是
A. 血、尿免疫固定电泳
B. 血清β₂微球蛋白测定
C. 尿常规
D. 尿本周蛋白测定
E. 血沉

正确答案：A。血、尿免疫固定电泳

解析：患者老年女性，乏力胸痛1个月，双侧肋骨有局部压痛（多发性骨髓瘤常导致骨骼损害，引起骨痛）；实验室检查：Hb80g/L（成年女性Hb正常值110～150g/L），提示贫血，WBC5.6×10⁹/L（正常4～10×10⁹/L），Plt120×10⁹/L（正常100～300×10⁹/L）；血清总蛋白100g/L（正常60～80g/L）增高，白蛋白27g/L（正常40～55g/L）降低，血肌酐190μmol/L（正常44～133μmol/L）增高；骨髓细胞学检查示骨髓中幼浆细胞占0.45（骨髓中浆细胞＞30%是诊断多发性骨髓瘤的主要指标），故患者诊断为多发性骨髓瘤可能性大，为明确诊断下一步应给予血、尿免疫固定电泳（A对）。血清β₂微球蛋白测定（B错）可用于评估肿瘤负荷和预后，但主要用于测定肾小管功能；尿常规（C错）可有蛋白尿，但无特异性；尿本周蛋白测定（D错）阳性仅见于半数患者，不如尿、血免疫球蛋白测定敏感；多发性骨髓瘤患者可出现血沉（E错）加快的异常表现，但没有特异性。